男性，58岁，因右下肢剧烈疼痛麻木发凉苍白6小时就诊。既往有多年房颤病史。最可能的诊断是
A. 血管闭塞性脉管炎
B. 动脉硬化性闭塞症
C. 动脉栓塞
D. 雷诺氏病
E. 深静脉血栓形成

正确答案：C。动脉栓塞

解析：左心房血栓脱落后，可顺血流方向经左心房→左心室→主动脉→髂外动脉→造成下肢动脉栓塞，表现为5P征，即疼痛、感觉异常、麻痹、无脉和苍白。老年男性，既往有多年房颤史（提示可存在左心房附壁血栓），出现右下肢剧烈疼痛、麻木、发凉、苍白，最可能的诊断是右下肢动脉栓塞（C对）。血管闭塞性脉管炎（P489）（A错）多见于青壮年男性，大多有吸烟嗜好，起病隐匿，进展缓慢，主要表现为患肢怕冷，苍白或发绀以及感觉异常。动脉硬化性闭塞症（P487）（B错）早期症状为患肢冷感、苍白，进而出现间歇性跛行；后期患肢皮温明显降低、色泽苍白或发绀，出现静息痛，肢体远端缺血性坏死或溃疡。雷诺病（P493）（D错）多见于青壮年女性，好发于手指，典型表现为受累部位依次出现苍白、青紫、潮红。下肢深静脉血栓形成（P502）（E错）表现为患肢突发肿胀，浅静脉扩张，患肢皮温及体温均升高。